产生裂片的原因是
A. 黏合剂用量不足或黏性不够
B. 压片时压力过大
C. A和B均是
D. A和B均不是

正确答案：C。A和B均是

解析：本题考查片剂制备中的常见问题及原因。黏合剂用量不足或黏性不够、压片时压力过大（C对）都会产生裂片。产生裂片的处方因素有：①物料中细粉太多，压缩时空气不能及时排出，导致压片后气体膨胀而裂片；②物料的塑性较差，结合力弱。